有人曾对日本的胃癌进行过移民流行病学调查研究，发现胃癌在日本高发，在美国低发。在美国出生的二代日本移民胃癌的死亡率高于美国人，但低于日本国内的日本人，说明
A. 环境因素对胃癌的发生有较大关系
B. 遗传因素对胃癌的发生有较大关系
C. 遗传和环境交互作用
D. 很难判断
E. 以上均不正确

正确答案：A。环境因素对胃癌的发生有较大关系